下列各项中，哪两脏可同有血虚的证候
A. 心、脾
B. 肝、脾
C. 心、肺
D. 心、肝
E. 肝、肾

正确答案：D。心、肝

解析：心血与肝血，基本上概括了全身之血液，心血虚则肝无所藏，肝血不足，则无以调节血液进入脉道，故心肝血虚可同时出现（D对）。若脾虚失运，化源不足，或统血无权，慢性失血，均可致血虚而心失所养。而劳神思虑过度，既耗心血，又损脾气，可形成心血虚、脾气虚证（A错）。肝、脾可有肝郁脾虚的证候，郁怒伤肝，肝失条达，横乘脾土；或饮食不节，损伤脾气，脾失健运，湿壅木郁，肝失疏泄均可致肝郁脾虚证（B错）。心、肺可共有的证候是气虚，若肺气虚，行血无力，可影响心的行血功能，致心气虚；心气虚，心阳不振，血行不畅，也可影响肺的呼吸功能，致肺气虚（C错）。肝、肾共有的证候为阴虚。肾阴不足可累及肝阴；肝肾阴虚。阴不制阳，水不涵木，又致肝阳上亢（E错）。